苯妥英钠中毒时，血药浓度通常高于
A. 1㎍/ml
B. 5㎍/ml
C. 10㎍/ml
D. 15㎍/ml
E. 20㎍/ml

正确答案：E。20㎍/ml

解析：本题考查苯妥英钠。苯妥英钠治疗血浆浓度为10-20µg/ml；血浆浓度超过20ug/ml（E对）时出现眼球震颤，超过40ug/ml时会出现严重不良反应，如嗜睡、昏迷。